社区获得性肺炎最常见的致病菌是
A. 流感嗜血杆菌
B. 肺炎支原体
C. 嗜肺军团菌
D. 肺炎链球菌
E. 葡萄球菌

正确答案：D。肺炎链球菌

解析：社区获得性肺炎（CAP）是指在医院外罹患的感染性肺实质炎症，包括具有明确潜伏期的病原体感染而在入院后平均潜伏期内发病的肺炎。肺炎链球菌是社区获得性肺炎最常见的致病菌（D对）。葡萄球菌是引起血源性肺脓肿最常见的病原菌（E错）。流感嗜血杆菌（A错）既是社区获得性肺炎的常见致病菌之一，也是医院获得性肺炎无感染高危因素患者常见的致病菌之一。肺炎支原体（B错）是社区获得性肺炎的常见致病菌之一。嗜肺军团菌（C错）既不是社区获得性肺炎也不是医院获得性肺炎的常见致病菌。